休克II期微循环灌流的特点是：
A. 多灌少流，灌多于流
B. 少灌少流，灌少于流
C. 少灌多流，灌少于流
D. 多灌多流，灌多于流
E. 多灌多流，灌少于流

正确答案：A。多灌少流，灌多于流

解析：多灌少流，灌多于流（A对BCDE错），组织呈淤血性缺氧状态是休克期（微循环淤血性缺氧期）微循环的灌流特点。少灌少流，灌少于流（B错）是休克初期微循环灌流的特点